常用分离培养军团菌的培养基是
A. 普通琼脂
B. BCYE琼脂
C. EMB琼脂
D. TSI琼脂
E. TTC肉汤琼脂

正确答案：B。BCYE琼脂

解析：本题考查常用分离培养军团菌的培养基。军团菌的分离培养可用BCYE-α琼脂培养基（B对ACDE错），该培养基中加入了适合军团菌生长繁殖的L-半胱氨酸、可溶性焦磷酸铁等。